我国发病率最高的食物中毒是
A. 化学性食物中毒
B. 有毒动物中毒
C. 有毒植物中毒
D. 细菌性食物中毒
E. 霉菌毒素食物中毒

正确答案：D。细菌性食物中毒

解析：我国发病率最高的食物中毒是细菌性食物中毒，最为常见（D对），发病率较高。化学性食物中毒发病率、病死率均较高，但在食物中毒中不是最常见的（A错）。动物性食物中毒发病率较高，病死率因含有毒成分不同而异（B错）。有毒植物中毒发病率和病死率因中毒食品种类不同而异（C错）。真菌及其毒素食物中毒发病率和病死率较高，发病有明显的季节性和地区性，但在食物中毒中不是最常见（E错）。